骨关节炎的主要病变是
A. 关节内化脓性感染
B. 关节特异性炎症
C. 关节软骨退变和继发性骨质增生
D. 关节骨质疏松
E. 骨与关节慢性疼痛

正确答案：C。关节软骨退变和继发性骨质增生

解析：概念性内容。骨关节炎是一种以关节软骨退行性变和继发性骨质增生（C对）为特征的慢性关节疾病。关节内化脓性感染（A错）为化脓性关节炎主要病变。关节特异性炎症（B错）指由特异性致病菌引起的关节内感染，如关节结核等。关节骨质疏松（D错）、骨与关节慢性（E错）可见于骨关节炎，但不是其主要病变，且还可见于多种疾病。